我国规定硝酸盐与亚硝酸盐用于肉制品不得超过
A. 0.3g/kg
B. 0.03g/kg
C. 3mg/kg
D. 0.3mg/kg
E. 0.03mg/kg

正确答案：B。0.03g/kg